某女，23岁。症见身热，微恶风寒，汗出不畅，头痛，咳嗽，咽燥，口渴，舌苔薄白，脉浮数，治疗应选用
A. 银翘散
B. 麻黄汤
C. 藿香正气散
D. 玉屏风散
E. 荆防败毒散

正确答案：A。银翘散

解析：风热犯表，热郁肌腠，卫表失和，故见身热，微恶风寒，汗出不畅；风热上扰故见头痛；风热之邪熏蒸清道故见咽喉肿痛，咽燥，口渴，鼻流浊涕；风热犯肺，肺失清肃故见咳嗽；痰黏或黄，舌苔薄白，脉浮数，均为风热侵于肺卫之证，治法为辛凉解表，方药选用银翘散或葱豉桔梗汤加减（A对）。麻黄汤（B错）可以发汗解表，宣肺平喘，用于治疗外感风寒表实证。藿香正气散（C错）可以清署祛湿解表，用于治疗暑湿伤表证。玉屏风散（D错）可以益气固表，用于治疗肺卫气虚证。荆防败毒散（E错）可以辛温解表，用于治疗风寒束肺证。